心理测验的原则是
A. 标准化
B. 稳定性
C. 社会化
D. 道德性
E. 独特性

正确答案：A。标准化

解析：应用心理测验时应坚持标准化原则（A对）、保密原则、客观性原则。标准化原则指测量应采用公认的标准化的工具，施测方法要严格根据测验指导手册的规定执行。保密原则指关于测验的内容、答案及记分方法只有作此项工作的有关人员才能掌握，不允许随意扩散，更不允许在出版物上公开发表。客观性原则指对结果的解释要符合受试者的实际情况。稳定性、社会化、道德性、独特性（BCDE错）均不是心理测验的原则